易引起高铁血红蛋白血症的毒物是
A. 二氯乙烷
B. 苯胺
C. 甲苯
D. 二硫化碳
E. 二氧化碳

正确答案：B。苯胺

解析：本题考查高铁血红蛋白血症的成因。苯胺（B对ACDE错）的主要毒性作用是其中间代谢产物苯胲，它有很强的将Fe²⁺氧化成Fe³⁺的能力，从而易形成高铁血红蛋白，使血红蛋白失去带氧功能，引起氧运输障碍，从而导致高铁血红蛋白血症。